上丘
A. 位于脑桥背侧面
B. 视觉性反射中枢
C. 深面有面神经膝
D. 深面有展神经核
E. 参与听觉反射

正确答案：B。视觉性反射中枢

解析：上丘位于中脑背侧面（A错），其深面有视觉性反射中枢（B对）。上丘下方为下丘，下丘深面的听觉反射中枢参与听觉反射（E错）。面神经膝（C错）、展神经核（D错）为面神经丘深面的结构。